男，45岁，因患严重精神分裂症，用氯丙嗪治疗，两年来用的氯丙嗪量逐渐增加至600mg/d，才能较满意的控制症状，但近日出现肌肉震颤，动作迟缓，流涎等症状，对此，应选何药纠正
A. 苯海索
B. 左旋多巴
C. 金刚烷胺
D. 地西泮
E. 溴隐亭

正确答案：A。苯海索